女，26岁。近1个月来出现失眠，难以入睡。食欲较差，体重减轻2kg。自觉无用、孤独，没有人关心自己，对未来也不抱任何希望，偶尔出现生不如死的想法。目前此患者存在的突出症状是
A. 睡眠障碍
B. “三自”症状
C. “三无”症状
D. 消极观念
E. 思维迟缓

正确答案：C。“三无”症状

解析：患者年轻女性，近1月来出现失眠，难以入睡（睡眠障碍）。食欲较差，体重减轻2kg（抑郁发作生物学症状）。自觉无用、孤独，没有人关心自己，对未来也不抱任何希望（典型的抑郁发作的“三无”症状，即无望、无助、无用），偶尔出现生不如死的想法（自杀观念）。根据患者的症状及病史可以诊断为抑郁障碍，虽然患者目前也有睡眠障碍的表现，但它并不是现阶段困扰患者的主要问题，而该患者有非常典型的“三无”症状，是该患者最突出的症状（C对A错）。“三自”症状（B错）主要表现为自罪、自责、自杀倾向，该患者只有偶尔轻微的自杀观念，故排除。消极观念（D错）为抑郁障碍的一般症状，普遍存在，不是该患者的最突出症状。且该患者没有明显的反应迟钝、思路闭塞等症状，可排除思维迟缓（E错）。